影响药物经皮吸收过程的因素不包括
A. 药物的溶解性
B. 药物的油/水分配系数
C. 药物的色泽
D. 药物的熔点
E. 药物的分子量

正确答案：C。药物的色泽